有关气雾剂中药物吸收影响因素的叙述，正确的有
A. 吸入给药时，药物的吸收速度与药物的脂溶性大小成反比
B. 吸入给药时，药物的吸收速度与药物的分子大小成反比
C. 起局部治疗作用的吸入气雾剂，雾滴的粒径一般以3～10μm为宜
D. 发挥全身作用的吸入气雾剂，雾滴的粒径一般以0.5～1μm为宜
E. 发挥全身作用的吸入气雾剂，雾滴的粒径愈小愈好

正确答案：B、C、D。吸入给药时，药物的吸收速度与药物的分子大小成反比；起局部治疗作用的吸入气雾剂，雾滴的粒径一般以3～10μm为宜；发挥全身作用的吸入气雾剂，雾滴的粒径一般以0.5～1μm为宜

解析：本题考查的是吸入气雾剂与喷雾剂的吸收与影响因素。有关气雾剂中药物吸收影响因素的叙述，正确的有吸入给药时，药物的吸收速度与药物的分子大小成反比（B对）、起局部治疗作用的吸入气雾剂，雾滴的粒径一般以3～10μm为宜（C对）与发挥全身作用的吸入气雾剂，雾滴的粒径一般以0.5～1μm为宜（D对）。影响吸入气雾剂和吸入喷雾剂药物吸收的主要因素有：①药物的脂溶性及分子大小，吸入给药的吸收速度与药物的脂溶性成正比（A错），与药物的分子大小成反比。②雾滴（粒）粒径大小，雾滴（粒）的大小影响其在呼吸道沉积的部位，吸入气雾剂雾滴（粒）的粒径应在10μm以下，其中大多数应在5μm以下。雾滴过粗，药物易沉着在口腔、咽部及呼吸器官的各部位；粒子过小，雾滴（粒）易到达肺泡部位，但沉积减少，多被呼出，吸收较少（E错）。